随机抽样调查甲、乙两地正常成年男子身高，得甲地身高的均值为175cm，乙地为179cm，经t检验得P＜0.05，差别有统计学意义。其结论为
A. 可认为两地正常成年男子平均身高相差不大
B. 甲、乙两地正常成年男子身高均值相差较大
C. 两地接受调查的正常成年男子平均身高不同
D. 可认为两地正常成年男子平均身高不同
E. 两地接受调查的正常成年男子平均身高差别较大

正确答案：D。可认为两地正常成年男子平均身高不同

解析：本题为两独立样本t检验，它适用于完全随机设计的两样本均数的比较，其目的是检验两样本所来自总体的均数是否相等。经t检验得P＜α，差别有统计学意义，可以认为甲乙两地正常成年男子平均身高不同（D对）。